五脏中，具有“刚脏”特性的是
A. 心
B. 肺
C. 脾
D. 肝
E. 肾

正确答案：D。肝

解析：刚脏指的是该脏具有刚强、躁急的生理特性。心位于胸中，在五行属火，为阳中之阳，主通明，故称为“阳脏”（A错）。肺叶娇嫩，不耐寒热燥湿诸邪之侵，且肺上通鼻窍，外合皮毛，易受外邪侵袭，有“娇脏”之称（B错）。脾的生理特性为脾气主升且脾喜燥恶湿，与刚脏特性不符（C错）。肝的生理特性是主升主动，喜条达而恶抑郁，具有刚强躁急的生理特性，肝内寄相火，其病理上肝气易升太过也反证肝气的刚强燥急特性，即为刚脏（D对）。肾有潜藏、封藏、闭藏的生理特性，与刚脏不符（E错）。